出血来源主要为脑膜中动脉的是
A. 脑震荡
B. 脑挫裂伤
C. 原发性脑干损伤
D. 急性硬脑膜外血肿
E. 慢性硬脑膜下血肿

正确答案：D。急性硬脑膜外血肿

解析：出血来源主要为脑膜中动脉的是急性硬脑膜外血肿（D对）。硬膜下血肿出血来源常为大脑浅层的静脉破裂及脑挫裂伤，也可来源于静脉窦和桥静脉损伤（E错）。脑组织遭受破坏较轻，软脑膜尚完整者为脑挫伤；而软脑膜、血管和脑组织同时有破裂，并伴有外伤性蛛网膜下腔出血者为脑裂伤（B错）。脑震荡和原发性脑干损伤显然错误（AC错）。